回力卡环卡环臂尖端位于基牙的
A. 颊面倒凹区
B. 舌面倒凹区
C. 近中面倒凹区
D. 远中面倒凹区
E. 邻间隙倒凹区

正确答案：A。颊面倒凹区

解析：回力卡环：常用于后牙游离端缺失，基牙为前磨牙或尖牙，牙冠较短或为锥形牙。卡环臂尖端位于基牙的唇（颊）面倒凹区，绕过基牙的远中面与支托相连接，再转向舌面的非倒凹区，在基牙近中舌侧通过连接体与腭（舌）杆相连。掌握“局部义齿固位体”知识点。